长期服用呋塞米，易发生的不良反应是
A. 低尿酸血症
B. 低钾血症
C. 高氯血症
D. 高钠血症
E. 高镁血症

正确答案：B。低钾血症

解析：本题考查呋塞米。长期服用呋塞米，易发生的不良反应是低钾血症（B对）。呋塞米属于袢利尿剂，袢利尿剂常见水、电解质紊乱，为过度利尿所引起，表现为低血容量、低血钾、低血钠（D错）、低氯性代谢性碱血症（C错）等，长期应用还可引起低血镁（E错），尤其是饮食摄入不足者，补充含有镁盐成分的制剂可以纠正。